世界上第一个安乐死合法化的国家是
A. 美国
B. 日本
C. 瑞典
D. 荷兰
E. 英国

正确答案：D。荷兰

解析：荷兰成为了全世界第一个允许安乐死的国家（D对）。